根据《中华人民共和国药品管理法》，开办药品批发企业必须具备的条件不包括
A. 具有依法经过资格认定的药学技术人员
B. 具有与所经营药品相适应的营业场所、设备、仓储设施、卫生环境
C. 具有与所经营药品相适应的质量管理机构或者人员
D. 具有保证所经营药品质量的规章制度
E. 具有能对所经营药品进行质量检验的人员以及必需的仪器

正确答案：E。具有能对所经营药品进行质量检验的人员以及必需的仪器

解析：本题考查的是药品批发企业开办条件。根据《中华人民共和国药品管理法》，开办药品批发企业必须具备的条件不包括具有能对所经营药品进行质量检验的人员以及必需的仪器（E错，为本题正确答案）。药品批发企业（含药品零售连锁企业总部）开办条件：从事药品批发活动，应当具备以下条件：（1）企业质量负责人具有大学本科以上学历，质量负责人、质量管理部门负责人应当是执业药师（A对）；企业法定代表人、主要负责人、质量负责人、质量管理部门负责人无《药品管理法》规定的禁止从事药品经营活动的情形。（2）具有能够保证药品储存质量、与其经营品种和规模相适应的仓库，仓库中配备适合药品储存的专用货架和设施设备。其中，药品批发企业设置的仓库还应当具备实现药品入库、传送、分拣、上架、出库等操作的现代物流设施设备（B对）。（3）具有独立的计算机管理信息系统，能覆盖企业药品经营和质量控制全过程，并实现药品信息化追溯。（4）具有所经营药品相适应的质量管理机构和人员（C对）。（5）具有保证药品质量的规章制度（D对），并符合药品GSP的要求。